追风透骨丸【处方】制川乌100g，白芷100g，制草乌100g，香附（制）100g，甘草100g，白术（炒）50g，没药（制）20g，麻黄100g，川芎100g，乳香（制）50g，秦艽50g，地龙100g，当归50g，茯苓200g，赤小豆100g，羌活100g，天麻50g，赤芍100g，细辛100g，防风50g，天南星（制）100g，桂枝50g，甘松50g。【制法】以上二十三味粉碎成细粉，过筛，混匀100g粉末用炼蜜55～65g。加适量水制成水蜜丸。另将滑石粉、红氧化铁、胭脂红适量，混匀作包衣材料包衣，干燥即得。处方中含有生物碱类成分，若炮制不当或服用过量可导致心律失常的饮片是
A. 香附（制）
B. 制川乌
C. 乳香（制）
D. 没药（制）
E. 天南星（制）

正确答案：B。制川乌

解析：本题考查的是川乌生物碱的临床应用。含有生物碱类成分，若炮制不当或服用过量可导致心律失常的饮片是制川乌（B对）。乌头类药物有川乌、草乌、附子、雪上一枝蒿等。中毒机制：主要有毒成分为乌头碱，一般中毒量为0.2mg，致死量为2～4mg。其毒性主要作用于神经系统，尤其是迷走神经等，使其先兴奋后抑制，并可直接作用于心脏，产生异常兴奋，可致心律失常，甚至引起室颤而死亡。